某男，75岁，患冠心病多年，症见胸部憋闷，胸痛，固定不移，心悸盗汗，气短乏力，舌质紫黯有瘀斑，脉细涩。证属心气虚乏、血瘀络阻，宜选用的成药是
A. 冠心苏合丸
B. 人参再造丸
C. 通心络胶囊
D. 九气拈痛丸
E. 血府逐瘀口服液

正确答案：C。通心络胶囊

解析：本题考查的是通心络胶囊的主治。患冠心病多年，症见胸部憋闷，胸痛，固定不移，心悸盗汗，气短乏力，舌质紫黯有瘀斑，脉细涩。证属心气虚乏、血瘀络阻，宜选用的成药是通心络胶囊（C对）。通心络胶囊：【主治】心气虚乏、血瘀络阻证所致的冠心病心绞痛，症见胸部憋闷、刺痛、绞痛、固定不移、心悸自汗、气短乏力、舌质紫黯或有瘀斑、脉细涩或结代。亦用于气虚血瘀络阻型中风病，症见半身不遂或偏身麻木、口舌㖞斜、言语不利。冠心苏合丸（A错）：【主治】寒凝气滞、心脉不通所致的胸痹，症见胸闷、心前区疼痛；冠心病心绞痛见上述证候者。人参再造丸（B错）：【主治】气虚血瘀、风痰阻络所致的中风，症见口眼㖞斜、半身不遂、手足麻木、疼痛、拘挛、言语不清。九气拈痛丸（D错）：【主治】气滞血瘀所致的胸胁胀满疼痛、痛经。血府逐瘀口服液（E错）：【主治】气滞血瘀所致的胸痹、头痛日久、痛如针刺而有定处、内热烦闷、心悸失眠、急躁易怒。